女性，50岁，近口角处颊黏膜白色斑块近l年，不能擦去。组织学见上皮增生，内有中性粒细胞浸润和散在微脓肿，角化层有垂直于上皮的PAS阳性菌丝，结缔组织内慢性炎症细胞浸润。最可能的病理诊断是
A. 白斑
B. 红斑
C. 口腔结核性炎
D. 念珠菌病
E. 慢性盘状红斑狼疮

正确答案：D。念珠菌病

解析：本题考查口腔念珠菌病的病理变化。病例中近口角处颊黏膜白色斑块近l年，不能擦去。组织学见上皮增生，内有中性粒细胞浸润和散在微脓肿，角化层有垂直于上皮的PAS阳性菌丝，结缔组织内慢性炎症细胞浸润，这些均符合口腔念珠菌病的临床和病理表现，最可能的病理诊断是口腔念珠菌病（D对）。红斑（B错）是红色病损呈红色。白斑（A错）病理表现无PAS阳性菌丝。口腔结核性炎（C错）患者有结核病史，口腔中有鼠啮状溃疡，结核菌纯蛋白衍生物（PPD）试验阳性。慢性盘状红斑狼疮（E错）口腔病损表现为：下唇唇红粘膜处，病变可超出唇红缘而累及皮肤，呈盘状，盘状周围放射状排列的细短白纹。无PAS阳性菌丝。